处方：碘50g，碘化钾100g，蒸馏水适量，制成复方碘溶液1000ml。碘化钾的作用是
A. 助溶作用
B. 脱色作用
C. 抗氧作用
D. 增溶作用
E. 补钾作用

正确答案：A。助溶作用

解析：本题考查液体制剂常用的附加剂。碘化钾的作用是助溶作用（A对）。助溶是指难溶性药物与加入的第三种物质在溶剂中形成可溶性分子间的络合物、缔合物或复盐等，以增加药物在溶剂中的溶解度。碘在水中的溶解度为1：2950，而在10%碘化钾溶液中可制成含碘5%的水溶液，这是由于碘化钾与碘形成了溶解度较大的配合物所致。